慢性髓系白血病可见
A. 骨髓细胞内可见Auer小体
B. 中性粒细胞碱性磷酸酶积分增高
C. Ph染色体阳性
D. 糖原染色阳性
E. 非特异性酯酶阳性，可被氟化钠抑制

正确答案：C。Ph染色体阳性